伤寒沙门菌的致病特点是
A. 不引起菌血症
B. 只在肠道内繁殖，引起肠道病变
C. 疾病全程均可取粪便进行微生物学检查
D. 病后可长期排菌
E. 病后获得短时间的免疫力

正确答案：D。病后可长期排菌